阳明头痛的“引经药”应首选
A. 葛根、白芷、知母
B. 羌活、川芎、蔓荆子
C. 柴胡、黄芩、川芎
D. 藁本、吴茱萸、钩藤
E. 细辛、白芷、羌活

正确答案：A。葛根、白芷、知母

解析：阳明头痛的引经药应选葛根、白芷、知母（A对），太阳头痛的引经药是羌活、川芎、蔓荆子（B错），少阳头痛的引经药是柴胡、黄芩、川芎（C错），厥阴头痛的引经药是藁本、吴茱萸、钩藤（D错），少阴头痛的引经药是细辛、白芷、羌活（E错）。